男性，突发寒战，体温39℃左右，腹泻10余次，伴里急后重，便为稀便，很快转化为脓血便。便常规红细胞5/HP，白细胞10/HP，脓细胞（++）。该患者如确诊，还需何种检查
A. 粪便细菌培养
B. 血常规
C. 尿常规
D. 腹部平片
E. 血细菌培养

正确答案：A。粪便细菌培养

解析：男性患者，突发寒战，体温39℃左右，腹泻10余次（细菌性痢疾急性期的常见表现），伴里急后重（提示病变累及直肠），粪便由稀便很快转为脓血便（菌痢能导致肠黏膜坏死、溃疡），便常规见红细胞、白细胞及脓细胞（符合菌痢的粪便检查结果），综合该患者的病史、体查、实验室检查，该患者考虑诊断为细菌性痢疾。该患者如确诊，还需进行粪便细菌培养（A对）。细菌性痢疾的确诊有赖于病原学检查，应尽量于病程的早期阶段、抗菌药物应用之前进行标本采集，应该取患者有脓血或黏液的粪便进行细菌培养。痢疾杆菌的菌体通常在肠道固有层内繁殖生存，其释放的内毒素和外毒素是造成病变破坏的致病因素（P179），严重时常导致毒血症，但并发菌血症、败血症少见（P181），故一般不采用血细菌培养（E错）。血常规（B错）、尿常规（C错）、腹部平片（D错）不属于病原学检查范畴，对细菌性痢疾的确诊帮助不大。